食品安全风险监测技术机构的职责说法错误的是
A. 根据食品安全风险监测计划和监测方案开展监测工作
B. 保证监测数据真实、准确
C. 食品安全风险监测工作人员有权进入食品生产经营场所采集样品
D. 采集样品不需要支付任何费用
E. 按照食品安全风险监测计划和监测方案的要求报送监测数据和分析结果

正确答案：D。采集样品不需要支付任何费用